南沙参除清肺养阴外，又能
A. 退热除蒸
B. 凉血止血
C. 软坚散结
D. 明目，润肠
E. 祛痰，益气

正确答案：E。祛痰，益气

解析：本题考查的是南沙参的功效。南沙参除清肺养阴外，又能祛痰，益气（E对）。南沙参：【功效】清肺养阴，祛痰，益气。鳖甲：【功效】滋阴潜阳，退热除蒸（A错），软坚散结（C错）。墨旱莲：【功效】滋阴益肾，凉血止血（B错）。决明子：【功效】清肝明目，润肠通便（D错）。